脊神经的感觉性纤维的神经元胞体位于
A. 交感神经节
B. 脊神经节
C. 脊髓侧角
D. 脊髓前角
E. 脊髓后角

正确答案：B。脊神经节

解析：交感神经节（A错）为内脏运动纤维。脊神经节（B对）含有假单极感觉神经元。脊髓侧角（C错）、前角（D错）和后角（E错）含有躯体运动纤维。